某男，29岁，脘闷不舒，呕恶纳呆，时吐痰涎，头晕目眩，舌苔白腻，脉滑。临床诊断最可能是
A. 饮停与胃证
B. 痰阻于胃证
C. 痰迷心窍证
D. 痰停经脉证
E. 以上均非

正确答案：B。痰阻于胃证

解析：“脘闷不舒，呕恶纳呆”可定位病变部位在胃脘部；“时吐痰涎，头晕目眩，舌苔白腻，脉滑”为痰证的辨证要点，故可诊断为痰阻于胃证（B对）。饮停于胃，阻滞气机，胃失和降，可见脘腹痞胀，泛吐清水（A错）。痰迷心窍，则出现神昏、神乱等症（C错）。痰停经脉，气血不畅，可见肢体麻木、半身不遂（D错）。